半夏的炮制品种有
A. 姜半夏
B. 生半夏
C. 清半夏
D. 法半夏
E. 水半夏

正确答案：A、B、C、D。姜半夏；生半夏；清半夏；法半夏